椎动脉型颈椎病最突出的症状是
A. 恶心
B. 猝倒
C. 头痛，眩晕
D. 视物不清
E. 耳鸣，耳聋

正确答案：B。猝倒

解析：椎动脉型颈椎病患者，由于颈椎退变机械性压迫等因素导致椎动脉受压，基底动脉血流量减少，大脑后循环供血不足，典型表现为突发性眩晕而猝倒（B对）。选项中其余症状在多型颈椎病均可出现，无特异性。